应激时交感－肾上腺髓质系统兴奋所产生的防御性反应是
A. 心率增快，心肌收缩力增强
B. 支气管扩张加强通气
C. 促进糖原分解使血糖升高
D. 血液重分布
E. 以上都是

正确答案：E。以上都是

解析：心率增快，心肌收缩力增强（A对）、支气管扩张加强通气（B对）、促进糖原分解使血糖升高（C对）和血液重分布（D对，故E为本题正确答案）是应激时交感－肾上腺髓质系统兴奋所产生的防御性反应。